引起半月形切牙和桑葚状磨牙的病原体是
A. 梅毒螺旋体
B. 单纯疱疹病毒
C. 麻疹病毒
D. 水痘-带状疱疹病毒
E. 人类乳头瘤病毒

正确答案：A。梅毒螺旋体

解析：由母婴感染所致的先天性梅毒可引起特征性的牙缺陷。其中典型特征为半月形切牙和桑葚状磨牙。掌握“氟牙症、先天性梅毒牙与牙本质形成缺陷”知识点。